女，21岁，右臂肱骨干下骨折，拍x线片示：右前臂肱骨干下1/3骨折，易损伤的神经是
A. 正中神经浅支损伤
B. 肌皮神经
C. 桡神经损伤
D. 正中神经深支损伤
E. 腋神经

正确答案：C。桡神经损伤

解析：青年女性患者，右臂肱骨干下骨折，拍X线片示：右臂肱骨干下1/3骨折，由于在肱骨干中1/3段后外侧有桡神经沟，有由臂丛神经后束发出的桡神经自内后方紧贴骨面斜向外前方进入前臂，故易损伤的神经是桡神经损伤（C对）。正中神经损伤常由儿童肱骨髁上骨折和腕部切割伤引起（AD错）。肌皮神经部位隐蔽一般不容易损伤，可见于刺伤、枪击伤或手术误伤（B错）。腋神经损伤一般在临床上较为少见，一般可见于肱骨中上1/3骨折（E错）。